关于脊髓灰质的描述不对的是
A. 后角相当于I----VI层
B. 中间带相当于VII层
C. VIII-----IX层位于前角内
D. 前角内有α、γ及Renshaw神经元
E. γ神经元支配梭内肌感觉

正确答案：E。γ神经元支配梭内肌感觉

解析：Ⅰ层相当于后角边缘核，Ⅱ层相当于胶状质，Ⅲ、Ⅳ层相当于后角固有核（A对）。中间带相当于VII层（B对）。Ⅷ层相当于前角基底部，Ⅸ层相当于前角内、外侧核（D对）。γ－运动神经元支配梭内肌纤维，其作用与肌张力调节有关（E错，为本题正确选项）。